不是由A族溶血性链球菌引起的疾病是
A. 亚急性细菌性心内膜炎
B. 猩红热
C. 风湿热
D. 急性肾小球肾炎
E. 蜂窝组织炎

正确答案：A。亚急性细菌性心内膜炎

解析：①A族溶血性链球菌引起的化脓性感染有：淋巴管炎、扁桃体炎、中耳炎等；②A族溶血性链球菌引起的变态反应性疾病有：风湿热、急性肾小球肾炎；③A族溶血性链球菌引起的中毒性疾病：猩红热。而亚急性细菌性心内膜炎是由甲型溶血性链球菌（草绿色链球菌）引起的。掌握“链球菌属”知识点。